围生期包括胎儿期一部分和婴儿期一部分，国内普遍采用的定义是
A. 胎龄27周～出生时
B. 胎龄28周～生后7天
C. 胎龄30周～生后2周
D. 胎龄36周～生后4周
E. 胎龄38周～生后1个月

正确答案：B。胎龄28周～生后7天

解析：围生期国内普遍采用的定义是胎龄28周—生后7天（B对）。围生儿很容易受到胎内、分娩过程中及出生后各种因素的影响而患病，甚至死亡，因此，衡量一个国家医疗卫生水平的重要指标是围生期死亡率。